患者从卧位转为立位时，血压80/60mmHg，心率115次/分，其机制为
A. 主动脉神经传入冲动减少，心交感传出增强
B. 主动脉神经传入冲动减少，心交感传出减少
C. 窦神经传入冲动减少，心交感传出增强
D. 窦神经传入冲动减少，心迷走传出增强
E. 窦神经传入冲动增强，心迷走传出增强

正确答案：C。窦神经传入冲动减少，心交感传出增强

解析：当人体由平卧位转为直立位时，足部血管内的血压比平卧时高，增高的部分约为 80mmHg, 相当于从足到心脏这一段血柱所产生的静水压。这时动脉血压降低，压力感受器传入冲动减少（窦神经），心迷走传出减弱，压力感受性反射减弱，引起心率加快，心输出增多，外周阻力增大，血压回升（C对）。